矽肺线X线胸片表现与患者的临床症状的病变程度
A. 一定平行
B. 不一定平行
C. 前者重于后者
D. 后者重于前者
E. 没有关系

正确答案：B。不一定平行

解析：本题考查矽肺的临床表现。肺的代偿能力很强，矽肺病人可在相当长时间内无明显自觉症状，但X线胸片上已呈现较显著的矽肺影像改变。随着病情的进展，或有合并症时，可出现胸闷、气短、胸痛、咳嗽等症状和体征，无特异性，虽可逐渐加重，但与胸片改变并不一定平行（B对ACDE错）。